为评价乙脑疫苗的效果，随机确定某地1000名儿童接种该疫苗，并随访3年，结果95%的接种者未发生该病。就疫苗的效果而言，以下哪一个结论最正确
A. 疫苗效果很好，因为有很高的保护率
B. 疫苗效果很好，因为有很高的效果指数
C. 尚不能下结论，因为没有观察未接种者
D. 尚不能下结论，因为没有作假设检验
E. 尚不能下结论，因为不知血清抗体滴度

正确答案：C。尚不能下结论，因为没有观察未接种者